男性，19岁。无业青年，父亲是生意人，该青年5年来购买收藏女性高跟鞋，晚上抱着睡觉，在心理咨询门诊诊断为“恋物癖”，此类患者最好的治疗方法
A. 人本主义
B. 厌恶治疗
C. 自由联想
D. 系统脱敏
E. 梦的分析

正确答案：B。厌恶治疗

解析：厌恶治疗（B对）是通过直接或间接想象将某种不愉快的刺激与个体的不良行为结合起来，使个体最终厌恶并放弃这种行为的一种疗法。题中的男患者有收集女性高更鞋的恋物癖，可以通过反复的厌恶刺激来消退这一不良行为。人本主义（P223）（A错）强调以人为本，向患者提供自我发现的环境，帮助患者认识正视自己的情绪和问题。一般适用于社交恐惧，某些神经症患者。自由联想（P205）（C错）和梦的分析（P206）（E错）属于精神动力学疗法，一般适用于神经症性障碍，比如抑郁症和焦虑症。系统脱敏疗法（P211）（D错）主要用于治疗恐怖症，也可用于癔症。